多发性溃疡的部位是
A. 胃体部和胃窦部都有溃疡
B. 胃和十二指肠都有溃疡
C. 十二指肠降部和食管下段都有溃疡
D. 十二指肠球部和食管下段都有溃疡
E. 胃窦部和食管下段都有溃疡

正确答案：A。胃体部和胃窦部都有溃疡

解析：溃疡较深，可见到肌肉组织，通常在内镜下发现的到达黏膜肌层深度的损伤，称为溃疡。胃或十二指肠溃疡病灶一般为单个，若胃或十二指肠出现两个或两个以上溃疡，称为多发性溃疡，故胃体部和胃窦部都有溃疡为多发性溃疡（CDE错）。多发部位在胃底和胃窦部（A对）。胃和十二指肠都有溃疡为复合性溃疡（B错）。